牙周炎骨吸收在X线片上的表现为牙槽骨
A. 高度降低
B. 形态不变
C. 密度增加
D. 骨硬板增厚
E. 牙周膜变窄

正确答案：A。高度降低

解析：本题考查牙槽骨吸收的X线表现。牙周炎骨吸收在X线片上的表现为牙槽骨高度降低（A对）。患牙周炎时，由于牙槽骨的破坏，硬骨板常不完整或消失，硬骨板的表现在一定程度上可以反映出疾病的变化，在疾病治疗前或活动期，硬骨板往往消失（D错）；待牙周治疗后，硬骨板则重新形成，且呈致密连续影；对于维护期的患者和牙位应该定期复查拍摄X线片，通过观察硬骨板的变化可以间接判断病情的恢复情况及稳定性。牙槽骨吸收的X线表现是：牙槽嵴顶硬骨板密度减低（C错），或呈虫蚀状（B错），高度降低。由于牙槽骨的破坏，牙周膜间隙也相应显示增宽或明显增宽（E错）。